腭裂术后穿孔或部分裂开，术后至少多长时间可行二期手术
A. 1～2个月
B. 3～4个月
C. 5～7个月
D. 6～12个月
E. 以上都不对

正确答案：D。6～12个月

解析：腭裂术后穿孔不论大小，都不要急于立即再次手术缝合，因组织脆弱血供不良，缝合后常会再次裂开，建议术后6～12个月，嘱患者复诊后再行二期手术为好。掌握“唇腭裂的序列治疗”知识点。